在肝正中裂内走行的是
A. 肝门静脉右支
B. 肝中静脉
C. 肝右静脉
D. 肝左静脉
E. 肝门静脉左支

正确答案：B。肝中静脉

解析：肝中静脉(B对)在肝正中裂内走行，肝右静脉(C错)在右叶间裂内走行，肝左静脉(D错)在左段间裂内走行。